为了更有利于药物吸收，罗红霉素片口服的时间要求是
A. 饭前
B. 饭后
C. 睡前
D. 吃饭时
E. 必要时

正确答案：A。饭前

解析：本题考查罗红霉素的使用。罗红霉素对酸的稳定性好，应饭前（A对）服用。饭后（B错）食物会影响药物的吸收。睡前（C错）胃肠道蠕动变慢，吸收不好。吃饭时服用（D错），与食物一起会阻碍药物的吸收。药物的服用要按时且持续，必要时（E错）再服用不有利于药物的吸收。